6岁，女孩。出生后反复呼吸道感染，平时少活动。体检：无发绀，心前区稍隆起，胸骨左缘3～4肋间Ⅲ级粗糙全收缩期杂音，伴震颤，P₂轻度亢进。哪一项不是该病常出现的合并症
A. 肺水肿
B. 支气管肺炎
C. 脑血栓
D. 充血性心力衰竭
E. 亚急性感染性心内膜炎

正确答案：C。脑血栓

解析：室间隔缺损时由于肺循环血量大于体循环血量，肺部血液淤积，容易并发支气管肺炎（B对）、充血性心力衰竭（D对）、肺水肿（A对）及感染性心内膜炎（E对）。缺损部位处于心室，压力较大，血流湍急，不易形成血栓（C错，为本题正确答案）。